夜间阵发性呼吸困难，可见于
A. 急性脑血管疾病
B. 癔病
C. 急性感染所致的毒血症
D. 慢性阻塞性肺气肿
E. 左心功能不全

正确答案：E。左心功能不全

解析：夜间阵发性呼吸困难是心源性呼吸困难，其发生的机制是：①睡眠时迷走神经兴奋性增高，冠状动脉收缩，心肌供血减少，降低心功能；②仰卧位肺活量减少，回心血量增多，肺淤血加重,可见于左心功能不全（E对）。急性脑血管疾病（人卫八版诊断学P24）（A错）可发生神经性呼吸困难，主要由于呼吸中枢受到颅内压增高和供血减少的刺激，使呼吸变为深而慢，常伴呼吸节律改变。癔病（B错）可发生精神性呼吸困难，主要由于过度通气而发生呼吸性碱中毒导致呼吸频率变为浅而快，伴有叹息样呼吸或出现手足抽搐。急性感染所致的毒血症（人卫八版诊断学P23）（C错）可发生中毒性呼吸困难，主要由于急性感染时，体温升高和毒性代谢产物增加引起代谢性酸中毒刺激颈动脉窦、主动脉体化学感受器或者直接兴奋呼吸中枢而导致呼吸深长、频率增加。慢性阻塞性肺气肿（人卫八版诊断学P22）（D错）可发生呼气性呼吸困难，主要由于肺泡弹性减弱和（或）小支气管痉挛或炎症导致呼气费力、呼气缓慢、呼气相延长。